某女，36岁，带下色白，量多稀薄，头晕目眩，耳鸣，腰膝酸软，小便频数，大便溏薄，舌质淡润，苔薄白，脉沉迟。其证候是
A. 湿热
B. 痰湿
C. 肾虚
D. 肝郁
E. 脾虚

正确答案：C。肾虚

解析：本题考查的是带下变化的临床意义。带下色白，量多稀薄，头晕目眩，耳鸣，腰膝酸软，小便频数，大便溏薄，舌质淡润，苔薄白，脉沉迟。其证候是肾虚（C对）。带下变化的临床意义：正常情况下，妇女阴道内应有少量乳白色、无臭的分泌物，有濡润阴道壁的作用。若分泌过多或缠绵不绝，即为带下。其中色白、量多淋沥者，为白带；白带中混有血液、赤白分明的，为赤白带；带下淡红黏稠、似血非血，称为赤带；其色淡黄、黏稠臭秽，是为黄带。临床以白带、黄带较为多见。问带下，应注意了解量的多少，色质和气味等。若带下量多色白、清稀如涕，多属脾虚（E错）湿注；带下色黄、黏稠臭秽或伴有外阴瘙痒疼痛，多属湿热（A错）下注；带下色赤、淋沥不断、微有臭味，多属肝经郁热（D错）；带下晦暗、质稀薄而多、腰腹酸冷，多属肾虚。总之，凡带下色白而清稀的，多属虚证、寒证；色黄或赤，稠黏臭秽的，多为实证、热证。